绿原酸的分离纯化多使用
A. 强酸性阳离子交换树脂
B. 弱酸性阳离子交换树脂
C. 强碱性阴离子交换树脂
D. 弱碱性阴离子交换树脂
E. 大孔吸附树脂

正确答案：C。强碱性阴离子交换树脂